二陈汤的药物组成有
A. 半夏、陈皮、甘草、人参
B. 人参、白术、陈皮、半夏
C. 半夏、陈皮、甘草、乌梅
D. 半夏、陈皮、茯苓、竹茹
E. 半夏、陈皮、厚朴、苏叶

正确答案：C。半夏、陈皮、甘草、乌梅

解析：二陈汤方含半夏、橘红、白茯苓、炙甘草。用法：每服四钱（12g），用水一盏，生姜七片，乌梅一个（C对），同煎六分，去滓，热服，不拘时候。二陈汤方歌—二陈汤用半夏陈，益以茯苓甘草臣，利气和中燥痰湿，煎加生姜与乌梅。